人居环境建设的基本原则，正确的是
A. 生态原则、经济原则、技术原则
B. 技术原则、社会原则、生态原则
C. 文化原则、生态原则、社会原则
D. 生态原则、经济原则、技术原则、社会原则、文化原则
E. 生态原则、社会原则、经济原则

正确答案：D。生态原则、经济原则、技术原则、社会原则、文化原则

解析：本题考查人居环境建设的基本原则。人居环境建设的基本原则包括：①生态原则：正视生态困境，提高生态意识；②经济原则：人居环境建设与经济建设良性互动；③技术原则：发展科学技术，推动社会发展；④社会原则：关怀广大人民群众，重视社会整体利益；⑤文化原则：科学追求与艺术创造相结合（D对ABCE错）。